较长时间接触90dB（A）以上的强烈噪声，可使听力明显下降，听阈提高15～30dB（A），离开噪声环境数小时至20多小时后听力才能恢复，这称为
A. 听觉适应
B. 听力适应
C. 听觉疲劳
D. 神经性听力损失
E. 噪声性耳聋

正确答案：C。听觉疲劳

解析：本题考查听觉疲劳。较长时间接触90dB（A）以上的强烈噪声，可使听力明显下降，听阈提高15～30dB（A），离开噪声环境数小时至20多小时后听力才能恢复，称为听觉疲劳（C对BD错）。继续接触强噪声，内耳感音器官（螺旋器）由功能性改变发展为器质性退行性病变，听力损失不能完全恢复，可发展为听力损伤和噪声性耳聋（E错）。短期接触80dB（A）以上的强烈噪声使人感到刺耳、不适、耳鸣、听力下降、听阈提高10～l5dB（A），离开噪声环境数分钟后可完全恢复，这是一种保护性生理功能，称为听觉适应（A错）。